莪术与三棱均具有的功效是
A. 破血行气，消积止痛
B. 破血逐瘀，续筋接骨
C. 活血止痛，消肿生肌
D. 活血消癥，通经下乳
E. 活血通经，利尿通淋

正确答案：A。破血行气，消积止痛

解析：本题考查的是莪术与三棱的功效。莪术与三棱均具有的功效是破血行气，消积止痛（A对）。莪术：【功效】破血行气，消积止痛。三棱：【功效】破血行气，消积止痛。土鳖虫：【功效】破血逐瘀，续筋接骨（B错）。乳香：【功效】活血止痛，消肿生肌（C错）。穿山甲：【功效】活血消癥，通经下乳（D错），消肿排脓。牛膝：【功效】活血通经，利尿通淋（E错），引血下行，补肝肾，强筋骨。